语颤增强多见于
A. 肺实变
B. 胸膜肥厚
C. 肺气肿
D. 气胸
E. 胸腔积液

正确答案：A。肺实变

解析：语音震颤是指被检查者发出语音时，声波起源于喉部，沿气管、支气管及肺泡，传到胸壁所引起的共鸣的振动，可由检查者的手触及。语音震颤的强弱主要取决于气管、支气管是否通畅，胸壁传导是否良好而定。语颤增强可见于肺实变（A对）、压迫性肺不张、较浅而大的肺空洞。肺实变时肺组织传导声波的能力较正常肺组织强，当声波通过畅通的气管、支气管传到实变肺组织，再传到胸壁时语颤增强。胸膜肥厚（B错）、肺气肿（C错）、气胸（D错）、胸腔积液（E错）时语颤减弱。